锰从体内排出的主要途径是
A. 呼吸道
B. 肾脏
C. 消化道
D. 皮肤
E. 头发

正确答案：C。消化道